耐酸、耐酶、抗菌活性不及青霉素，与青霉素有交叉过敏
A. 青霉素V
B. 苯唑西林
C. 替卡西林
D. 哌拉西林
E. 舒巴坦

正确答案：A。青霉素V